没有成瘾性，兼有中枢和外周镇咳药是
A. 右美沙芬
B. 氯化铵
C. 可待因
D. 苯丙哌林
E. 羧甲司坦

正确答案：D。苯丙哌林

解析：本题考查苯丙哌林。没有成瘾性，兼有中枢和外周镇咳药是苯丙哌林（D对）。苯丙哌林主要抑制肺和胸膜牵张感受器引起的肺-迷走神经反射，也能抑制咳嗽中枢，是兼有外周和中枢作用的强效镇咳药。镇咳作用强于可待因，口服后15～20分钟起效，作用维持4～7小时。右美沙芬（A错）是合成的吗啡类衍生物，为非依赖性中枢性镇咳药。氯化铵（B错）属于刺激性祛痰药。可待因（C错）为中枢性镇咳药。羧甲司坦（E错）为黏液调节剂类祛痰药。